温经汤《妇人大全良方》的组成药物有
A. 白芍、生地、当归、麦冬、沙参、枸杞子
B. 白芍、当归、丹皮、川芎、牛膝、莪术
C. 白芍、熟地、丹皮、黄柏、青蒿、茯苓
D. 白芍、生地、地骨皮、麦冬、玄参、阿胶
E. 白芍、生地、当归、丹皮、沙参、茯苓

正确答案：B。白芍、当归、丹皮、川芎、牛膝、莪术

解析：温经汤的功效为温经散寒，活血祛瘀，由当归、川芎、白芍、桂心、丹皮、莪术、人参、甘草、牛膝组成，方歌妇人良方温经汤，人参芎归贵通阳，芍药甘草缓急痛，莪丹牛膝引血良（B对）。